百部的主要功效是
A. 化痰
B. 止咳
C. 平喘
D. 清肺
E. 泻肺

正确答案：B。止咳

解析：该题考查百部的功效，属记忆内容。百部味甘、苦，性微温；入肺经；具有润肺止咳，杀虫灭虱的功效（B对ACDE错）。